肾精不足所致头痛的特点是
A. 隐痛
B. 绞痛
C. 胀痛
D. 刺痛
E. 空痛

正确答案：E。空痛

解析：头痛有虚实之分。凡气血阴精亏虚，不能上荣于头所致者，多属虚证。肾精不足，不能上荣于头，头目失养，故头空痛（E对）。隐痛表现为疼痛不剧烈，尚可忍耐，但绵绵不休的症状；多因阳气精血亏虚，脏腑经脉失养所致（A错）。绞痛表现为痛势剧烈，如刀绞割的症状；多因有形实邪阻闭气机，或寒邪凝滞气机所致（B错）。胀痛表现为疼痛兼有胀感或胀甚于痛；常表现为部位不固定，因情绪波动而加剧，嗳气、矢气而减轻，是气滞作痛的特点（C错）。刺痛表现为疼痛如针刺或刀割，通常部位比较固定，夜间尤甚，是瘀血致痛的特点（D错）。